移植排斥反应损伤机制中能澈活CTL、NK杀伤移植物，使B细胞产生抗体的细胞因子是
A. IL-1
B. IL-8
C. IL-2
D. IL-4
E. IL-5

正确答案：C。IL-2